功能失调性子宫出血的临床特点
A. 月经周期紊乱，经期延长，出血量时多时少，甚至大量出血，一般不伴痛经
B. 包括精神紧张、环境变化、气候骤变、过度劳累、营养不良及全身性疾病
C. 绝经后阴道出血
D. 接触性出血
E. 凝血功能异常

正确答案：A。月经周期紊乱，经期延长，出血量时多时少，甚至大量出血，一般不伴痛经

解析：本题考查功能失调性子宫出血的临床特点。功能失调性子宫出血的临床特点是月经周期紊乱，经期长短不一，出血量不定时少时多，甚至出现突破性大出血而致贫血或休克，一般不伴有痛经或其他不适（A对BCDE错）。